男，48岁，糖尿病12年，每日皮下注射胰岛素治疗，早餐前30单位，晚餐前24单位，每日进餐规律，主食量350g。近来查空腹血糖13.6～14.8mmol/L，餐后2小时血糖7.6～8.8mmol/L。关于空腹高血糖。确定原因最有意义的检查是
A. 多次测定空腹血糖
B. 多次测定餐后血糖
C. 多次测定夜间血糖
D. 测定糖化血红蛋白
E. 口服葡萄糖耐量试验

正确答案：C。多次测定夜间血糖

解析：患者规律使用胰岛素替代治疗与饮食治疗后出现空腹高血糖，餐后血糖控制尚可，可能的原因为“黎明现象”或Somogyi效应，应予夜间多次血糖测定以鉴别空腹高血糖的原因（C对）。多次测定空腹血糖（A错）、多次测定餐后血糖（B错）用于血糖的日常监测，对明确空腹血糖升高的原因没有价值。糖化血红蛋白（D错）用于反映近2～3个月来血糖的控制情况。口服葡萄糖耐量试验（E错）主要用于确诊糖尿病。